牙周炎患者牙周袋内放药最佳时机是
A. 龈上洁治前放药
B. 龈上洁治后放药
C. 龈下刮治前放药
D. 龈下刮治后放药
E. 以上时机均可

正确答案：D。龈下刮治后放药

解析：本题考查牙周炎患者牙周袋内放药的最佳时机。龈下刮治术是用比较精细的龈下刮治器除去位于牙周袋内及根面上的牙石和菌斑。在龈下刮治后，牙周袋内的大部分细菌和牙石被清除，此时放入牙周局部治疗药物，有利于控制菌斑的发展，促进创口愈合，效果良好。因此牙周炎患者牙周袋内放药最佳时机是龈下刮治后（D对）。